心力衰竭时有关心率加快的叙述，哪项是不正确的
A. 心率加快可贯穿于心功能不全的全过程
B. 心率加快是最容易被迅速动员起来的一种代偿活动
C. 心率越快其代偿效果越好
D. 心率加快可能与交感神经兴奋有关
E. 代偿作用有限

正确答案：C。心率越快其代偿效果越好

解析：心衰时，心输出量减少，心脏本身通过心率增快、心脏紧张源性扩张、心肌收缩性增强、心室重塑进行代偿。心率增快是最容易被迅速动员起来的一种代偿活动（B错），可贯穿于心功能不全的全过程（A错），其可能与心排血量减少使压力感受器受到的刺激减弱、容量感受器受到的刺激增强导致交感神经兴奋有关（D错）。但心率增快代偿作用有限（E错），心率越快，心肌耗氧越重，且心脏舒张期越短，使心室充盈减少，心排血量降低，代偿效果反而变差（C对）。